低渗性缺水的常见病因是
A. 大量出汗
B. 摄入水不足
C. 急性机械性肠梗阻
D. 大量使用利尿酸类利尿药
E. 急性化脓性腹膜炎

正确答案：D。大量使用利尿酸类利尿药

解析：大量使用利尿酸类利尿药（即袢利尿剂，其主要作用在髓袢升支粗段，可选择性地抑制Nacl的重吸收），可致排钠多于排水，造成低渗性缺水（D对）。大量出汗（汗液为低渗液）（A错）、摄入水不足（B错）常致高渗性缺水。急性病因如急性机械性肠梗阻（C错）、急性化脓性腹膜炎（E错）常致等渗性缺水。